女，25岁。突发呼吸困难2天。发病前有鼻痒、喷嚏症状，既往有类似病史。查体：R20次/分，双肺呼吸相略延长，未闻及干湿性啰音，心率90次/分，心率齐。该患者行肺功能检查最可能的异常是
A. 功能残气量减少
B. 肺活量下降
C. 肺总量下降
D. FEV₁/FVC下降
E. 一氧化碳弥散量下降

正确答案：D。FEV₁/FVC下降

解析：患者突发呼吸困难，发病前有鼻痒、喷嚏症状（变应原刺激），既往有类似病史，双肺呼吸相略延长，最可能为支气管哮喘。该患者行肺功能检查最可能的异常是FEV₁/FVC下降（D对）。